含膦酰基，在体内可经肝或肾双通道代谢生成活性物的ACE抑制剂是
A. 赖诺普利
B. 福辛普利
C. 马来酸依那普利
D. 卡托普利
E. 雷米普利

正确答案：B。福辛普利

解析：本题考查福辛普利。福辛普利（B对）是含有膦酰基的ACE抑制剂的代表，部分经肾清除，部分经肝清除，从肠道排泄，为“双通道”代谢。赖诺普利（A错）为直接有效的ACE抑制剂，口服活性好。马来酸依那普利（C错）不含有膦酰基。卡托普利（D错）可直接抑制ACE，分子中也不含有膦酰基。雷米普利（E错）是前体药物，经胃肠道吸收后在肝脏水解生成雷米普利拉，但不含膦酰基。